关于糖尿病孕妇及其新生儿的叙述不正确的是
A. 妊娠前已有糖尿病的患者妊娠，称为糖尿病合并妊娠
B. 雌激素和孕激素增加母体对葡萄糖的利用
C. 孕妇空腹血糖较非孕妇低，易发生低血糖及酮症酸中毒
D. 新生儿糖尿病发生率增高
E. 胎盘合成多种激素产生胰岛素抵抗，孕妇体内胰岛素分泌量相应增加

正确答案：D。新生儿糖尿病发生率增高